以下哪项不属于妊娠早期常见影响胎儿发育的问题
A. 主动或被动吸烟
B. 均小骨盆
C. 孕期宫内感染
D. 孕期发热
E. 饮酒

正确答案：B。均小骨盆

解析：本题考查妊娠早期常见影响胎儿发育因素。均小骨盆（B错，为本题正确答案）是分娩期评估是否存在影响阴道分娩的因素的内容。妊娠早期常见影响胎儿发育因素：孕妇主动或被动吸烟（A对）、饮酒（E对）、孕期宫内感染（C对）、孕期发热（D对）。